药用辅料的作用有
A. 使制剂成型
B. 使制备过程顺利进行
C. 降低药物毒副作用
D. 提高药物疗效
E. 提高药物稳定性

正确答案：A、B、C、D、E。使制剂成型；使制备过程顺利进行；降低药物毒副作用；提高药物疗效；提高药物稳定性

解析：本题考查药用辅料的作用。药用辅料的作用有：（1）使制剂成型（A对）；（2）使制备过程顺利进行（B对）；（3）提高药物稳定性（E对）；（4）提高药物疗效（D对）；（5）降低药物毒副作用（C对）；（6）调节药物作用；（7）提高病人用药的顺应性。